与上牙痛关系最密切的经脉是
A. 手阳明大肠经
B. 手太阳小肠经
C. 足少阳胆经
D. 足阳明胃经
E. 手少阳三焦经

正确答案：D。足阳明胃经

解析：手阳明大肠经入下齿中："其支脉，从缺盆部上行至颈部，经面颊进入下齿之中。"足阳明胃经入上齿中：“足阳明胃经，起于鼻旁，上行鼻根，与足太阳经脉相交会，再沿鼻的外侧下行，入上齿龈中，返回环绕口唇。”所以与上牙痛关系最密切的经脉是足阳明胃经（D对）。除此之外，督脉、冲脉、任脉循行都经过口唇。